颈部肿块，溃后脓水清稀，夹有败絮物，疮口潜行性空腔，经久难愈，其诊断是
A. 流痰
B. 颈痈
C. 锁喉痈
D. 瘰疬
E. 失荣

正确答案：D。瘰疬

解析：瘰疬是一种发生于颈部的慢性化脓性疾病，相当于西医的颈部淋巴结结核，其临床表现分为：1.初期：以颈部一侧或双侧出现豆粒大的结块表现为主。2.中期：以结核增大，皮核黏连表现为主。3.以结核溃破或切开后脓水清晰，夹有败絮样物，疮口呈潜行性空腔表现为主（D对）。流痰是一种发于骨与关节间的慢性化脓性疾病，破损后脓液稀薄如痰，好发于骨与关节，脊椎最多（A错）。颈痈是发生在颈部两侧的急性化脓性疾病，以颈部的红、肿、热、痛，严重时可化脓，溃脓出黄白稠厚.溃后逐渐痊愈为主要表现（B错）。锁喉痈是发于颈前正中结喉处的急性化脓性疾病，表现为结喉部红肿绕喉，根脚散漫，坚硬灼热疼痛，甚可化脓，溃后脓出黄稠或稀薄（C错）。失荣是发于颈部及耳之前后的岩肿，表现为颈部淋巴结肿大，质地坚硬，日久癌肿溃破，疮面渗流血水，形似翻花状（E错）。